伴有肾功能不全的感染患者应避免使用，但必须使用时，应当调整给药剂量才可使用的抗菌药物是
A. 头孢他啶
B. 妥布霉素
C. 琥乙红霉素
D. 青霉素
E. 阿莫西林

正确答案：B。妥布霉素

解析：本题考查妥布霉素。氨基糖苷类抗菌药物如妥布霉素（B对）对肾功能不全者应避免应用，必须使用时需进行血药浓度监测，调整给药剂量。头孢他啶（A错）对肾功能减退者应减少治疗剂量。琥乙红霉素（C错）、青霉素（D错）和阿莫西林（E错）对肾功能不全者可按原治疗剂量应用。